原子外轨道含有一个或多个不成对电子的分子或分子片段的是
A. 亲电子剂
B. 自由基
C. 亲核剂
D. 氧化还原反应物
E. 终毒物

正确答案：B。自由基